关于口腔扁平苔藓描述正确的是
A. 是一种急性炎症性疾病
B. 发病缓慢，无恶变现象
C. 中老年男性患者较多
D. 仅单独发生于口腔
E. 已列入癌前状态

正确答案：E。已列入癌前状态

解析：口腔扁平苔藓（OLP）是一种皮肤-黏膜慢性炎症性疾病，可以单独发生于口腔或皮肤，也可皮肤与黏膜同时罹患。损害除见于口腔外，也可见于生殖器，指甲与（或）趾甲，但比较少见。中年女性患者较多。因其长期糜烂病损有恶变现象，WHO将其列入癌前状态。掌握“口腔扁平苔藓”知识点。